男，67岁。头痛、呕吐数天。4个月前有头部摔伤史。头颅CT示右额颞顶新月形中等密度影。最有助于进一步明确诊断的检査是
A. CT增强扫描
B. MRI检查
C. 脑脊液检查
D. 脑血管造影
E. 脑电图

正确答案：B。MRI检查

解析：老年男性患者，头痛、呕吐数天（颅内压增高的表现），4个月前有头部摔伤史，头颅CT示右额颞顶新月形中等密度（慢性硬膜下血肿的典型影像学表现），结合患者病史、临床表现和影像学检查，应考虑为慢性硬膜下血肿。患者已行CT检查，最有助于进一步明确诊断的检査是MRI（B对）。MRI表现为新月形短T1，长T2信号影，可以确诊慢性硬膜下血肿。CT增强扫描（A错）、脑血管造影（D错）主要用于颅内动脉瘤、脑血管畸形的诊断；脑脊液检查（C错）主要用于化脓性、结核性脑膜炎等中枢系统感染性疾病的诊断；脑电图（E错）主要用于癫痫、精神性疾病的诊断，上述四种检查方法均不能确诊慢性硬膜下血肿。